由肠系膜下动脉分支供应的器官是
A. 阑尾
B. 胰
C. 横结肠
D. 降结肠
E. 空肠

正确答案：D。降结肠

解析：降结肠（D对）、乙状结肠和直肠上段均为由肠系膜下动脉分支供应的器官。